不宜采用塑化疗法的是
A. 根尖孔尚未闭合的年轻恒牙
B. 乳牙
C. 根管闭锁的前牙
D. A+B
E. A+B+C

正确答案：D。A+B

解析：本题考查塑化疗法。塑化治疗的适应证：①仅适用于成年人根尖部尚未破坏的后牙，包括不能做活髓保存的牙髓疾病、急性根尖周炎、根尖部尚未破坏的慢性根尖周炎；②根管条件特殊的患牙：患牙根管细窄、弯曲，包括老年人的患病前牙；器械折断在根管中，尚未超出根尖孔，取出困难，可以采用塑化治疗。塑化夜塑化凝固后不可吸收，且会将髓腔中的坏死或有活力牙髓包裹固化，使尚有活力的牙髓不能分化出成牙本质细胞，影响未发育完全的牙根继续发育，因此根尖孔尚未闭合的年轻恒牙（A错）不宜采用塑化治疗。塑化治疗也不可用于乳牙（B错），否则会影响乳牙牙根的生理性吸收，感染乳恒牙替换。根管闭锁的前牙（C对）根管几乎不存在，很难进行根管预备、牙胶根管充填，塑化液未固化前流动性强，可以流入根管闭锁的前牙，封闭狭小的根管系统，防止根尖周感染。（AB均错，故D为本题的正确答案）。